中药水提浓缩液中加人壳聚糖而使高分子杂质絮凝沉降被去除的方法是
A. 水提醇沉法
B. 吸附澄清法
C. 大孔树脂吸附法
D. 超滤法
E. 反渗透法

正确答案：B。吸附澄清法